抽样研究中，适当增加观察单位数，可
A. 减小Ⅰ型错误
B. 减小Ⅱ型错误
C. 减小抽样误差
D. 提高检验效能
E. 以上均正确

正确答案：E。以上均正确